下列可作制药用水的是
A. 注射用水
B. 饮用水
C. 蒸馏水
D. 纯化水
E. 灭菌注射用水

正确答案：A、B、D、E。注射用水；饮用水；纯化水；灭菌注射用水

解析：本题考查的是制药用水的种类。下列可作制药用水的是注射用水（A对）、饮用水（B对）、纯化水（D对）及灭菌注射用水（E对）。制药用水因其使用的范围不同而分为饮用水、纯化水、注射用水及灭菌注射用水。一般应根据各生产工序或使用目的与要求选用适宜的制药用水。①饮用水：饮用水可用于药材净制时的漂洗、制药用具的粗洗用水。除另有规定外，也可作为饮片的提取溶剂。②纯化水：纯化水可作为配制普通药物制剂用的溶剂或试验用水；可作为中药注射剂、滴眼剂等灭菌制剂所用饮片的提取溶剂；口服、外用制剂配制用溶剂或稀释剂；非灭菌制剂用器具的精洗用水。也用作非灭菌制剂所用饮片的提取溶剂。纯化水不得用于注射剂的配制与稀释。③注射用水：注射用水可作为配制注射剂、滴眼剂等的溶剂或稀释剂及容器的精洗。④灭菌注射用水：主要用于注射用灭菌粉末的溶剂或注射剂的稀释剂。